产后三病是指
A. 呕吐、泄泻、盗汗
B. 尿失禁、缺乳、大便难
C. 血晕、发热、痉证
D. 病痉、病郁冒、大便难
E. 腹痛、恶露不下、发热

正确答案：D。病痉、病郁冒、大便难

解析：产后三病为病痉、病郁冒、病大便难，属记忆内容（D对）。